男，66岁，高血压心脏病，心功能不全，EKG示Ⅱ度房室传导阻滞，两肺底闻及湿啰音，此时不宜选择下列哪一种降压药物
A. 卡托普利
B. 硝苯地平
C. β受体阻滞剂
D. 噻嗪类利尿剂
E. 哌唑嗪

正确答案：C。β受体阻滞剂